欠填是指根管内充填物距根尖端
A. 0.5～2mm
B. 1～2mm
C. ＞2mm
D. ＞3mm
E. 超出根尖孔

正确答案：C。＞2mm

解析：本题考查欠填。欠填是指根管内充填物距根尖端＞2mm（C对）。临床上采取根尖X线片检查判断根管充填的质量，根据根充物的影像特征以及临床疗效分为以下情况：1.恰填：X线片显示充填物均匀致密，充填物间以及充填物与根管壁间无空隙，严密封闭整个根管系统；充填物距根尖0.5～2mm（A错）。恰填是根管治疗术取得长远疗效的基本保证。2.欠填：X线片显示以下影像之一或多个同时存在，均为欠填。包括：充填物稀疏；根充物间不致密；根充物与根管壁间存在空隙；根尖1/3只有糊剂而无牙胶尖；根充物距根尖大于2mm。欠填因根管预备未到达根管工作长度、根管系统的渗漏而导致治疗失败。3.超填：在严密封闭根管系统情况下充填材料超出根尖孔到达根尖周组织。超填可能会引起术后不适和疼痛，但长远预后效果良好。4.超充：尽管根管充填材料超出根尖孔到达根尖周组织，但根管系统未实现严密封闭，根管内感染物仍与根尖周组织相通，该种情况治疗预后效果差。